与每人居住面积定额关系较密切的指标是
A. 人口净密度
B. 人口毛密度
C. 居住区用地面积
D. 居住建筑用地面积
E. 居住区人口数

正确答案：A。人口净密度

解析：本题考查居住区环境质量评价指标。单位住宅用地上居住的人口数量，称为人口净密度。每个人居住的面积定额是指每个人所拥有的居住空间大小，它取决于当地人口的密度，也就是每平方公里所拥有的人口数。因此，每人居住面积定额与人口净密度（A对BCDE错）有密切的关系。